睾丸可以分泌激素，其分泌功能又受其他激素的控制，了解相互的调控将有助理解男性生理和年龄特征。产生雄激素的细胞是
A. 精子细胞
B. 支持细胞
C. 睾丸间质细胞
D. 精原细胞
E. 精母细胞

正确答案：C。睾丸间质细胞

解析：睾丸间质细胞（C对）可产生雄性激素，位于生精小管之间的结缔组织内。